根据现况调查资料可计算出
A. 发病率
B. 患病率
C. 死亡率
D. 治愈率
E. 病死率

正确答案：B。患病率

解析：本题考查患病率的资料来源。患病率（B对ACDE错）的资料主要来源于现况调查、筛检等。